下列各项，不属月经先后不定期肾虚证主要症状的是
A. 经行或先或后
B. 月经量少色淡暗
C. 小腹冷痛拒按
D. 头晕耳鸣腰痛
E. 舌淡苔白，脉细弱

正确答案：C。小腹冷痛拒按

解析：肾虚则封藏失司，冲任失调，血海蓄溢无常，致经行先后不定（A对）。肾气亏损，阴阳两虚，阴不足故经血少，阳不足故经色淡黯（B对）。小腹冷痛拒按为寒邪侵袭所致的实证（C错，为本题正确答案）。腰为肾之府，肾虚腰府失养，故腰痛，肾藏精，肾虚精少，不能充养清窍，故头晕耳鸣（D对）。舌淡苔白，脉细弱符合肾虚的舌脉（E对）。